关于右美沙芬药理作用及临床评价的说法，正确的是
A. 通过阻断肺-胸膜的牵张感受器产生的肺迷走神经反射而起到镇咳作用
B. 口服吸收缓慢，主要经肝脏代谢，作用时间长
C. 镇咳作用弱于可待因
D. 主要用于干咳，但左旋右美沙芬有镇痛作用
E. 兼有外周和中枢性镇咳作用

正确答案：D。主要用于干咳，但左旋右美沙芬有镇痛作用

解析：本题考查右美沙芬。右美沙芬主要用于干咳，但左旋右美沙芬有镇痛作用（D对），无镇咳作用。阻断肺-胸膜的牵张感受器产生的肺迷走神经反射（A错）的药物是苯丙哌林。右美沙芬是通过对延髓咳嗽中枢的抑制而发挥中枢性镇咳作用，口服吸收迅速（B错），主要经肝脏代谢。与可待因相比其镇咳强度相等或略强（C错）。右美沙芬主要用于干咳，为中枢性镇咳药（E错）。